属于抗雄性激素的肿瘤药是
A. 氟他胺
B. 炔雌醇
C. 阿那曲唑
D. 他莫昔芬
E. 丙酸睾酮

正确答案：A。氟他胺

解析：本题考查抗肿瘤药。抗雄激素类肿瘤药的代表药为氟他胺（A对）。炔雌醇（B错）为雌激素类肿瘤药物。阿那曲唑（C错）为芳香氨酶抑制剂抗肿瘤药。他莫昔芬（D错）为抗雌激素的肿瘤药。丙酸睾酮（E错）为雄激素。